系统性红斑狼疮患者特异性最高的抗体是
A. 抗Sm抗体
B. 抗SSA抗体
C. 抗dsDNA抗体
D. 抗核抗体ANA
E. 抗RNA抗体

正确答案：A。抗Sm抗体

解析：抗Sm抗体是红斑狼疮的标记性抗体，特异性可高达99%，但敏感性较差，对于早期不典型的红斑狼疮诊断有很大的帮助（A对）；抗SSA抗体对于SLE患者无疾病特异性（B错）；抗dsDNA抗体，其敏感性约为70%，特异性可高达95%，是红斑狼疮的特异性抗体之一，抗双链DNA抗体的滴度通常与疾病的活动性密切相关，是红斑狼疮活动性的监测指标之一（C错）；抗核抗体ANA见于几乎所有的SLE患者，但特异性低，它的阳性不能作为SLE与其他结缔组织病的鉴别依据（D错）；抗RNA抗体阳性可见于系统性硬皮病、系统性红斑狼疮、其他结缔组织病（E错）。